硝苯地平对血管平滑肌的作用除外的是
A. 能明显舒张血管
B. 主要作用于静脉
C. 舒张脑血管作用较尼莫地平弱
D. 冠状血管较为敏感
E. 增加冠脉流量及侧支循环量

正确答案：B。主要作用于静脉

解析：硝苯地平对血管平滑肌作用：血管平滑肌对钙通道阻滞药的作用很敏感。该类药物能明显舒张血管，主要舒张动脉，对静脉影响较小。动脉中又以冠状血管较为敏感，能舒张大的输送血管和小的阻力血管，增加冠脉流量及侧支循环量。脑血管也较敏感，尼莫地平舒张脑血管作用较强，能增加脑血流量。掌握“钙通道阻滞药药理作用和不良反应”知识点。